偏食生冷寒凉之品，最易耗伤
A. 脾肾阳气
B. 肺肾阳气
C. 心肾阳气
D. 脾胃阳气
E. 肺胃阳气

正确答案：D。脾胃阳气

解析：本题考察饮食偏嗜中寒热偏嗜导致机体出现的病变。过分嗜好偏寒或偏热的饮食，可导致人体阴阳失调。其中，偏食生冷寒凉之品，最易耗伤脾胃阳气（D对）；而偏嗜辛温燥饮食，可导致胃肠积热。其余选项不是过食生冷直接损伤的脏腑（ABCE错）。